托法适用于疮疡的哪一期
A. 初期
B. 中期
C. 后期
D. 愈合期
E. 以上均非

正确答案：B。中期

解析：外疡中期即成脓期，此时热盛肉腐，由于一时疮口不能溃破或机体正气虚弱无力托毒外出，均会导致脓毒滞留。此时的治法是使用托法（B对），根据病人体质强弱和邪毒盛衰状况，分为补托和透托两种方法。消法可使初起的肿疡邪毒不至结聚成脓而得到消散，适用于疮疡初期（A错）。补法是用补养的药物恢复其正气，助养其新生，使疮口早日愈合的治疗法则，适用于溃疡后期和愈合期（CD错）。